戒烟项目中完全不吸烟属于
A. 无转变打算阶段
B. 打算转变阶段
C. 转变准备阶段
D. 转变行为阶段
E. 行为维持阶段

正确答案：D。转变行为阶段